下列各项是正常胎位的是
A. 肩左前
B. 肩左后
C. 枕左前
D. 枕右后
E. 骶右后

正确答案：C。枕左前

解析：临床上以枕左前的胎位最正常（C对），其他的均可能导致难产（ABDE错）。